不符合左向右分流先天性心脏病共同特征的是
A. 胸骨左缘收缩期杂音
B. 容易并发肺部感染
C. 生长发育落后
D. 肺动脉瓣区第二心音增强
E. 蹲踞现象

正确答案：E。蹲踞现象

解析：右向左分流先天性心脏病才会出现蹲踞现象（E错，为本题正确答案），右向左分流时，导致静脉血进入了动脉血，从而使动脉血氧含量减少。患儿蹲踞时下肢屈曲，使静脉回心血量减少，减轻了心脏负荷，同时下肢动脉受压，体循环阻力增加，使右向左分流量减少，缺氧症状暂时得以缓解，故蹲踞现象出现在右向左而不都是左向右分流的先天性心脏病。左向右分流先天性心脏病可出现：①胸骨左缘收缩期杂音，收缩期左心的收缩压增加，从而发生左向右分流（A对）。②容易并发肺部感染，当发生左向右分流时，导致右心前负荷增加，于是肺动脉回流发生障碍，大量的血淤积在肺部，血是细菌最好的培养基，因此易发生肺部感染（B对）。③生长发育落后，大量的血液从左心直接进入右心，使循环血量减少，影响小儿的生长发育（C对）。④肺动脉区第二心音增强，发生左向右分流时，右心的血容量增加，从而使肺动脉的前负荷增加，所以肺动脉区第二心音增强（D对）。